为一种非典型的龋病损害，主要发生于上颌前牙唇面的新生带处，称为
A. 平滑面龋
B. 隐匿性龋
C. 猖獗龋
D. 慢性龋
E. 线性釉质龋

正确答案：E。线性釉质龋

解析：本题考查龋病概述。线性釉质龋（E对）是一种非典型性龋病损害，主要发生于上颌前牙唇面的新生线处，或更确切的说是新生带。新生带是乳牙具有的组织学特征。